根尖周肉芽肿患者若根尖部出现修复性反应，称为
A. 急性根尖周肉芽肿
B. 慢性根尖周脓肿
C. 急性根尖周脓肿
D. 致密性骨炎
E. 化脓性骨髓炎

正确答案：D。致密性骨炎

解析：本题考查急慢性根尖周炎。根尖周肉芽肿患者若根尖部出现修复性反应，称为致密性骨炎（D对）。肉芽肿可呈现修复性反应，炎症减轻，吸收处骨质重新沉积，骨小梁增生，骨髓腔缩小，骨髓被纤维组织取代。与此同时牙骨质也可在根面沉积，产生牙骨质过度增生，称为致密性骨炎。